含铜IUD的主要作用机制不包括
A. 影响子宫内膜糖原代谢和激素摄取
B. 使宫颈黏液稠厚，不利于精子穿透
C. 铜离子使精子头尾分离，不能获能
D. 使受精卵运行速度与子宫内膜发育不同步
E. 压迫局部子宫内膜产生炎症反应

正确答案：B。使宫颈黏液稠厚，不利于精子穿透

解析：改变宫颈黏液性状，使宫颈黏液稠厚，不利于精子穿透（B错，为本题正确答案）为左炔诺孕酮IUD的避孕作用。含铜宫内节育器是目前我国应用最广泛的IUD（宫内节育器）。含铜IUD影响糖原代谢、雌激素摄入（A对）及DNA合成，使内膜细胞代谢受到干扰，使受精卵着床及囊胚发育受到影响。铜离子具有使精子头尾分离的毒性作用，使精子不能获能（C对）。长期异物刺激导致子宫内膜损伤及慢性炎症反应，产生前列腺素，改变输卵管蠕动，使受精卵运行速度与子宫内膜发育不同步（D对），受精卵着床受阻。子宫内膜受压（E对）缺血及吞噬细胞的作用，激活纤溶酶原，局部纤溶酶活性增强，致使囊胚溶解吸收。